下列含有核黄素的辅酶是
A. FMN
B. HS-CoA
C. NAD⁺
D. NADP⁺
E. CoQ

正确答案：A。FMN

解析：含有核黄素（维生素B₂）的辅酶是FMN（A对）和FAD。NAD⁺（C错）、NADP⁺（D错）含有维生素是维生素PP。HS-CoA（辅酶A）（B错）含有的维生素是泛酸。CoQ（E错）又称泛醌，是一种小分子、脂溶性醌类化合物，其是氧化呼吸链的递氢体。